目前空气中颗粒物直径测试法是
A. 在显微镜下用测微尺测量其几何长度
B. 以颗粒物不同形状来测量
C. 在较平静的气流中被测颗粒的直径相当于与其具有相同终末沉降速度，密度为1的球形标准颗粒物的直径
D. 以颗粒物重量表示
E. 以颗粒物比重表示

正确答案：C。在较平静的气流中被测颗粒的直径相当于与其具有相同终末沉降速度，密度为1的球形标准颗粒物的直径

解析：本题考查空气中颗粒物直径测试法。目前空气中颗粒物直径测试法是在较平静的气流中被测颗粒的直径相当于与其具有相同终末沉降速度，密度为1的球形标准颗粒物的直径（C对ABDE错）。